在295-300nm有最大紫外吸收
A. 甲型强心苷
B. 乙型强心苷
C. 丙型强心苷
D. 丁型强心苷
E. 戊型强心苷

正确答案：B。乙型强心苷

解析：本题考查的是强心苷的紫外光谱。在295-300nm有最大紫外吸收乙型强心苷（B对）。在217-220nm有最大紫外吸收甲型强心苷（A错）。没有丙型强心苷（C错）、丁型强心苷（D错）、丙型强心苷（E错）。